哪对鳃弓在中线处可以联合
A. 第6对鳃弓
B. 第1对和第2对鳃弓
C. 第3对鳃弓
D. 第4对鳃弓
E. 第5对鳃弓

正确答案：B。第1对和第2对鳃弓

解析：第1对和第2对鳃弓生长较快并在中线联合；第3、4、5对鳃弓由于中线处有发育中的心脏而未达到中线。掌握“鳃弓与神经嵴”知识点。